致死剂量（浓度）包括
A. 半数致死剂量
B. 绝对致死剂量
C. 最小致死量
D. 半数致死浓度
E. 以上都是

正确答案：E。以上都是